TCR识别Ag后向细胞传递信息的分子是
A. CD2
B. CD3
C. CD4
D. CD8
E. CD28

正确答案：B。CD3